初次感染结核，产生变态反应的时间为
A. 48～72小时
B. 1周
C. 2周
D. 3周
E. 4～8周

正确答案：E。4～8周

解析：结核分枝杆菌感染后需4～8周（E对ABCD错）才建立充分的变态反应，在此之前，结核菌素试验可呈阴性。